可引起周围神经炎的药物是
A. 利福平
B. 异烟肼
C. 阿昔洛韦
D. 吡嗪酰胺
E. 卡那霉素

正确答案：B。异烟肼

解析：利福平（A错）可引起的不良反应包括胃肠道反应、肝脏毒性、“流感综合征”（大剂量间隔使用可诱发发热、寒战、头痛、肌肉酸痛等类似感冒的症状）、皮疹药物热等其他重症反应。异烟肼（B对）的不良反应可引起的不良反应包括神经系统（常见不良反应为周围神经炎）、肝脏毒性、皮疹发热胃肠道等其他不良反应。阿昔洛韦（C错）属于抗疱疹病毒药，其最常见的不良反应为胃肠道功能紊乱、头痛和斑疹。比嗪酰胺（D错）长期大量使用可发生肝脏损害，用药期间定期检查肝功。卡那霉素（E错）属于氨基糖苷类，不良反应较大，目前仅与其他抗结核药物合用，治疗对第一线药物产生耐药性的结核患者。